与细菌毒力无关的是
A. 荚膜
B. 芽胞
C. 内毒素
D. 菌毛
E. 血浆凝固酶

正确答案：B。芽胞

解析：本题考查与细菌毒力有关的结构。与细菌毒力无关的是芽胞（B错，为本题的正确答案）。细菌毒力的物质基础是侵袭力和毒素，侵袭力包括荚膜（A对）、普通菌毛（D对）、侵袭性酶（血浆凝固酶）（E对）等，毒素包括内毒素（C对）与外毒素。芽胞是细菌的休眠形式，不直接引起疾病，仅当芽胞发芽成为繁殖体后，才能迅速大量繁殖而致病。